女，38岁。粘液脓血便伴里急后重3年。近1周腹痛加重。体检：体温37.5℃，贫血貌，左下腹部轻压痛。为明确诊断首选的检查是
A. 尿常规
B. 血清C-反应蛋白
C. 血清A19-9
D. 腹部CT
E. 结肠镜检查

正确答案：E。结肠镜检查

解析：该患者疑诊为溃疡性结肠炎，为明确诊断应首选结肠镜检查（E对）。尿常规（A错）一般用于检查肾脏疾病。血清C-反应蛋白（B错）升高见于感染、结核病、风湿性疾病等，无特异性，不用于明确诊断溃疡性结肠炎。血清A19-9（C错）用于检查胰腺癌和结直肠癌。腹部CT（D错）对空腔脏器疾病的诊断价值不大。